纤维素性炎症的好发部位应除外
A. 心包
B. 皮肤
C. 胸膜
D. 气管
E. 结肠

正确答案：B。皮肤

解析：纤维素性炎是以渗出物中含有大量纤维素为特征的炎症，易发生于①黏膜：如气管内壁（D对）、结肠内壁（E对）②浆膜：如胸膜（C对）、心包膜（A对）③肺组织。皮肤（B错，为本题正确答案）属于上皮组织，易发生蜂窝织炎（化脓性炎）。